通常只在部分青少年可听到的心音是
A. 第一心音
B. 第二心音
C. 第三心音
D. 第四心音
E. 第五心音额外心音

正确答案：C。第三心音

解析：第三心音由心室快速充盈的血流冲击室壁，使心室壁、腱索和乳头肌突然紧张、振动所致，仅出现于部分青少年（C对）中。第一心音（A错）、第二心音（B错）为心脏正常听诊音。第四心音（D错）的产生与心房收缩使房室瓣及其相关结构突然紧张、振动有关，第四心音一般听不到，如听到第四心音，则属于病理性。诊断学无第五心音概念（E错），额外心音一般属于病理性杂音。